种植覆盖义齿的优点
A. 增进舒适度
B. 增加义齿的固位
C. 增加义齿的稳定
D. 改善患者口腔功能
E. 以上说法均正确

正确答案：E。以上说法均正确

解析：种植覆盖义齿能够明显增加义齿的固位和稳定，改善患者口腔功能，增进舒适度，减少义齿压痛，故应对无牙颌修复的患者应优先给予介绍，便于患者自行选择。掌握“种植覆盖全口义齿”知识点。